锰进入机体主要损害
A. 神经系统
B. 消化系统
C. 造血系统
D. 呼吸系统
E. 内分泌系统

正确答案：A。神经系统